一位病人患左眼内斜视、左侧面部表情肌瘫痪、左耳听觉过敏，左侧舌前2／3味觉丧失。此外，左眼眨眼反射消失和左眼少泪，并伴有右半身上运动神经元瘫痪。该病人伴有面神经损害的交叉性瘫痪的病变部位必定位于
A. 延髓的内侧部
B. 延髓的后外侧部
C. 脑桥下部的内侧部
D. 脑桥中部的后外侧部
E. 中脑基底部

正确答案：C。脑桥下部的内侧部

解析：病人患左眼内斜视，可由于展神经受损所致，左侧面部表情肌瘫痪、左耳听觉过敏，左侧舌前2／3味觉丧失，左眼眨眼反射消失和左眼少泪，并伴有右半身上运动神经元瘫痪，可判定为面神经管内损伤，即脑桥下部的内侧部（C对）。